吗啡可用于治疗
A. 分娩疼痛
B. 便秘
C. 心源性哮喘
D. 颅内压升高
E. 前列腺肥大

正确答案：C。心源性哮喘

解析：本题考查吗啡的作用。吗啡可用于治疗心源性哮喘（C对）。吗啡可用于：1.镇痛；2.心肌梗死；3.心源性哮喘；4.麻醉和手术前给药；吗啡禁用于分娩止痛（A错）、颅脑损伤致颅内压增高（D错）患者；不可用于便秘（B错）和前列腺肥大（E错）。